男性输精管结扎常选部位是
A. 睾丸部
B. 精索部
C. 腹股沟部
D. 盆部
E. 输精管壶腹处

正确答案：B。精索部

解析：输精管精索部（B对）介于睾丸上端与腹股沟管皮下环之间，在精索内位于其他结构的后内侧，其位置表浅易于触及，为结扎输精管的理想部位。